男，50岁。持续胸痛8小时。喘憋2小时入院。既往无高血压病史。查体：BP150/70mmHg，端坐位，双肺可闻及少许细湿啰音，心界不大，心率110次/分，率齐，P₂＞A₂。心电图示I、aVL、V₁～V₆导联ST段抬高0.1～0.4mv。可见病理性Q波。该患者的心功能分级为
A. NYHA分级Ⅳ级
B. Killip分级Ⅲ级
C. NYHA分级Ⅲ级
D. Killip分级Ⅱ级
E. Killip分级I级

正确答案：D。Killip分级Ⅱ级

解析：题干内容提示急性心梗，应该选择Killip分级，不选择NYHA分级，少许湿啰音，提示低于50%，即killip II级。该患者端坐位，双肺可闻及少许细湿啰音（肺部啰音＜50%肺野）。因此该患者的心功能分级为Killip分级Ⅱ级（D对）。